男，50岁，2个月来间歇性无痛性血尿，近3天来加重伴有血块，B型超声双肾正常，膀胱内有1.5cm×2.0cm×l.0cm新生物，有蒂，目前最常用的治疗方法是
A. 膀胱灌注化疗
B. 经尿道电切
C. 开放手术
D. 放射治疗
E. 全身化疗

正确答案：B。经尿道电切

解析：中年男性患者，间歇性无痛性全血尿、伴有血块（提示可能有泌尿系肿瘤），B型超声双肾正常（可排除肾肿瘤），膀胱内有一带蒂的新生物（提示可能为膀胱肿瘤），结合患者病史、临床表现和B超检查，该患者最可能的诊断为膀胱肿瘤。该患者新生物1.5cm×2.0cm×l.0cm，有蒂，属于表浅的乳头状癌，TNM分期属Ta、T1期，对于Ta、T1期肿瘤，目前最常用的治疗方法是经尿道电切（B对）。膀胱灌注化疗（A错）主要用于原位癌、细胞分化良好者及预防TURBt后肿瘤的复发。开放手术（C错）即根治性膀胱全切术，是肌层浸润性膀胱癌的标准治疗方法。放射治疗（D错）对局部的晚期膀胱肿瘤患者有一定的疗效。全身化疗（E错）主要用于浸润性局部晚期及远隔转移的病人。关于不同临床分期膀胱癌的治疗现总结如下：Tis（原位癌）可行化疗药物或卡介苗（BCG）膀胱灌注治疗。Ta、T1期肿瘤行经尿道膀胱肿瘤电切术（TURBt），术后行膀胱灌注化疗。T2期低级别、局限的肿瘤可经尿道切除或行膀胱部分切除术。T3期低级别、单个局限、如病人不能耐受膀胱全切者可采用膀胱部分切除术；膀胱浸润性癌行根治性膀胱全切除术。T4期肌层浸润性癌常失去根治性手术机会，采用姑息性放化学治疗。